颧骨、颧弓骨折进行手术治疗的适应症是
A. 塌陷畸形
B. 开口受限
C. 复视
D. 仅轻度移位
E. A+B+C

正确答案：E。A+B+C

解析：颧骨、颧弓骨折的治疗：如仅有轻度移位，畸形不明显，无开口受限、复视及神经受压等功能障碍者，可作保守治疗。凡有塌陷畸形、开口受限、复视者均为手术适应证。虽无功能障碍但有明显畸形者也可考虑手术复位内固定。掌握“颧骨及颧弓、眼眶骨折及骨折愈合过程”知识点。